羟甲唑啉滴鼻剂使用期间，可能发生的不良反应是
A. 流泪
B. 鼻衄
C. 心率加快
D. 血压下降
E. 鼻黏膜肿胀

正确答案：C。心率加快

解析：本题考查羟甲唑啉的不良反应。羟甲唑啉滴鼻剂使用期间，可能发生的不良反应是心率加快（C对）。羟甲唑啉滴鼻剂不良反应有：滴药过频易致反跳性鼻充血，久用可致药物性鼻炎；少数人有轻微烧灼感、针刺感、鼻黏膜干燥以及头痛、头晕、心率加快等反应；罕见过敏反应。